髋关节脱位的最常见类型
A. 前脱位
B. 后脱位
C. 中心型脱位
D. 合并髋臼骨折的脱位
E. 合并股骨头骨折的脱位

正确答案：B。后脱位

解析：髋关节囊前壁有较强的髂股韧带，内上壁有耻骨囊韧带，后上壁有坐骨囊韧带加强。但内下壁和后下壁缺乏韧带，较为薄弱，容易从这两处发生脱位。其中最常见类型是后脱位，约占全部髋关节脱位的85%～90%（B对）。